以人群为基础的队列研究中，以下哪个分析指标是不恰当的
A. OR
B. RR
C. AR
D. AR%
E. PAR%

正确答案：A。OR

解析：本题考查队列研究的主要效应估计指标。队列研究的主要效应测量指标包括：①相对危险度（B对）；②归因危险度（C对）；③归因危险度百分比（D对）；④人群归因危险度；⑤人群归因危险度百分比（E对）。比值比OR（A错，为本题正确答案）为病例对照研究的指标。